属于含硫氨基酸的是
A. Trp
B. Thr
C. Phe
D. Met
E. Pro

正确答案：D。Met